关于普萘洛尔抗心律失常的叙述，错误的是
A. 用于运动和情绪激动引起的室性心律失常
B. 阻滞心脏的β₁受体
C. 减慢房室传导
D. 用于窦性心动过速
E. 加快浦肯野纤维的传导速度

正确答案：E。加快浦肯野纤维的传导速度

解析：普萘洛尔药理作用：1.降低自律性：普萘洛尔能阻断窦房结β受体（B对），防止交感活动对4相除极和异位起搏的影响，降低窦房结、心房、浦肯野纤维自律性。对正常心律影响小，但对运动、情绪激动或窦房结功能异常而引起的心率加快（D对），则使之明显减慢（A对）。2.减慢传导：大剂量具有膜稳定作用，可降低0相上升速率，明显减慢房室结及浦肯野纤维的传导（C对）（E错，为本题正确答案）。